足少阳胆经的络穴是
A. 丰隆
B. 大钟
C. 飞扬
D. 光明
E. 蠡沟

正确答案：D。光明

解析：光明穴在外踝高点上5寸，腓骨前缘，为足少阳胆经的络穴（D对）。丰隆为足阳明胃经的络穴（A错）。大钟为足少阴肾经的络穴（B错）。飞扬为足太阳膀胱经的络穴（C错）。蠡沟为足厥阴肝经的络穴（E错）。络穴趣记，公孙在内外关这样偏沟里，缺少支持，为了丰隆飞向光明。公孙、内关、外关、偏历、蠡沟、通里、列缺、支正、丰隆、飞扬、光明。